女性生殖器结核的临床特点不包括
A. 月经失调
B. 下腹坠痛
C. 低热
D. 不孕
E. 腹泻便秘交替

正确答案：E。腹泻便秘交替

解析：女性生殖器结核的临床表现依病情轻重、病情长短而异。常见的临床特点有不孕（D对）、月经失调（A对）、下腹坠痛（B对），经期加重、全身症状如低热（C对）、盗汗、乏力、食欲缺乏、体重减轻等。腹泻便秘交替（E错，为本题正确答案）多见于结核性腹膜炎。